根据《中华人民共和国行政诉讼法》，下列属于行政诉讼受案范围的是
A. 对行政机关吊销许可证行政处罚不服提起的诉讼
B. 对行政法规、规章提起的诉讼
C. 对行政机关制定、发布的具有普通约束力的决定、命令提起的诉讼
D. 对行政机关工作人员的奖惩、任免决定不服提起的诉讼
E. 对法律规定由行政机关最终裁决的具体行政行为提起的诉讼

正确答案：A。对行政机关吊销许可证行政处罚不服提起的诉讼

解析：本题考查的是行政诉讼的受案范围。根据《中华人民共和国行政诉讼法》，下列属于行政诉讼受案范围的是对行政机关吊销许可证行政处罚不服提起的诉讼（A对）。行政诉讼的受案范围包括：①对行政拘留、暂扣或者吊销许可证和执照、责令停产停业、没收违法所得、没收非法财物、罚款、警告等行政处罚不服的；②对限制人身自由或者对财产的查封、扣押、冻结等行政强制措施和行政强制执行不服的；③申请行政许可，行政机关拒绝或者在法定期限内不予答复，或者对行政机关作出的有关行政许可的其他决定不服的；④对行政机关作出的关于确认土地、矿藏、水流、森林、山岭、草原、荒地、滩涂、海域等自然资源的所有权或者使用权的决定不服的；⑤对征收、征用决定及其补偿决定不服的；⑥申请行政机关履行保护人身权、财产权等合法权益的法定职责，行政机关拒绝履行或者不予答复的；⑦认为行政机关侵犯其经营自主权或者农村土地承包经营权、农村土地经营权的；⑧认为行政机关滥用行政权力排除或者限制竞争的；⑨认为行政机关违法集资、摊派费用或者违法要求履行其他义务的；⑩认为行政机关没有依法支会抚恤金、最低生活保障待遇或者社会保险待遇的；⑪认为行政机关不依法履行、未按照约定履行或者违法变更、解除政府特许经营协议、土地房屋征收补偿协议等协议的；⑫认为行政机关侵犯其他人身权、财产权等合法权益的。另外，人民法院也受理法律、法规规定可以提起诉讼的其他行政案件。但对下列案件，人民法院不受理：①国防、外交等国家行为；②行政法规、规章（B错）或者行政机关制定、发布的具有普遍约束力的决定、命令（C错）；③行政机关对其工作人员的奖惩、任免等决定（D错）；④法律规定由行政机关最终裁决的行政行为（E错）；⑤公安、国家安全等机关依照刑事诉讼法的明确授权实施的行为；⑥行政调解行为以及法律规定的仲裁行为；⑦不具有强制力的行政指导行为；⑧驳回当事人对行政行为提起申诉的重复处理行为；⑨对公民、法人或者其他组织权利义务不产生实际影响的行为。